分泌激素使心跳加快和心肌收缩力增强
A. 位于蝶骨体的垂体窝内
B. 借漏斗连于下丘脑
C. 肾上腺髓质
D. 垂体
E. 松果体

正确答案：C。肾上腺髓质

解析：肾上腺素是由肾上腺髓质（C对）分泌的，肾上腺素的主要功能是作用于心肌，使心跳加快，心肌收缩力加强。